儿童营养需求特点包括
A. 个体之间营养需求差异不明显
B. 生长高峰矿物质的需求量增加
C. 儿童消化代谢与成人相同
D. 营养素需求量减少
E. 年龄越小营养缺乏病越少

正确答案：B。生长高峰矿物质的需求量增加

解析：本题考查儿童营养需求特点。①个体之间营养需求差异较为明显（A错）；②生长高峰矿物质的需求量增加（B对）；③儿童消化代谢与成人相同或超过成人（C错）；④营养素需求量增多（D错）；⑤年龄越小营养缺乏病越多（E错）。